在医务人员的行为中，不符合有利原则的是
A. 与解除患者的疾苦有关
B. 可能解除患者的疾苦
C. 使患者受益且产生的副作用很小
D. 使患者受益，但却给别人造成了较大的伤害
E. 在人体实验中，可能使受试者暂不得益，但却使社会、后代受益很大

正确答案：D。使患者受益，但却给别人造成了较大的伤害